《药品生产质量管理规范》规定，中药材的前处理、提取、浓缩等生产操作
A. 应避免与其它药品使用同一设备和空气净化系统
B. 应与其它药品生产厂房分开，并装有独立的专用的空气净化系统
C. 必须使用专用设备和独立的空气净化系统，并与其它药品生产区域严格分开
D. 不得同时在同一生产厂房内进行，其储存要严格分开
E. 必须与其制剂生产严格分开

正确答案：E。必须与其制剂生产严格分开